以下关于卫生防护距离的描述哪个有误
A. 卫生防护距离是指产生有害因素的企业、场所的主要污染源的边缘至住宅建筑用地边界的最小距离
B. 严重污染源的卫生防护距离内应设置防护林带
C. 卫生防护距离因污染源不同而距离不同
D. 卫生防护距离的制定是由各企业根据自己的企业性质制定的
E. 可将危害最大要求防护距离最远的工厂企业设置在离居住区最远的地段

正确答案：D。卫生防护距离的制定是由各企业根据自己的企业性质制定的

解析：本题考查卫生防护距离。卫生防护距离是指产生有害因素车间的边界至居住区边界的最小距离（A对），其应根据国家有关标准设置（D错，为本题正确答案）。卫生防护距离因污染源不同而距离不同（C对），严重污染源的卫生防护距离内应设置防护林带（B对）。可将危害最大要求防护距离最远的工厂企业设置在离居住区最远的地段（E对），然后由远及近配置危害由大到小的工厂。